建筑材料和装饰材料一般存在大量的污染物是
A. 二氧化碳、一氧化碳、苯、甲苯、
B. 二氧化氮、二氧化硫、三氯乙烯、氡
C. 二氧化碳、二氧化硫
D. 甲醛、苯、甲苯、二甲苯、三氯乙烯、氡
E. 一氧化碳、甲醛、苯、甲苯、二甲苯

正确答案：D。甲醛、苯、甲苯、二甲苯、三氯乙烯、氡

解析：本题考查建筑材料和装饰材料一般存在的大量污染物。建筑材料和装饰材料中含有大量有机污染物及放射性污染物，对人体危害极大。如：甲醛、苯、甲苯、二甲苯、三氯乙烯、氡（D对ABCE错）等，均可对人们的健康造成不可忽视的影响。